洞缘斜面的倾斜度为
A. 30°
B. 45°
C. 60°
D. 70°
E. 25°

正确答案：B。45°

解析：本题考查洞缘斜面的倾斜度。洞缘斜面是在箱状洞形的洞面角处做成的斜面，其作用是为了防止无支持的牙釉柱折断，以保护薄弱的洞壁和脆弱的牙尖，也可使修复体边缘与洞形边缘更密合，使黏固剂不易被唾液所溶解。根据釉柱的方向与材料的强度和性能，在洞的边缘上做成长短、斜度不同的斜面，一般（牙合）面的洞缘斜面与轴壁约成45°（B对），金属材料的修复体强度比较大，适合预备成洞缘斜面，而烤瓷或者全瓷材料的修复体强度比较小，易崩瓷，不适合预备成洞缘斜面。在所有嵌体的洞缘处做45°，宽0.5-1毫米的短斜面，使最终的嵌体边缘外形连续准确而完整。如果斜面坡度过大做成60°（C错）、70°（D错），则相对的降低了洞的深度，会削弱固位。若果斜面坡度过小做成30°（A错）、25°（E错），会减低修复体边缘的强度。